常用的分层因素有年龄、性别、文化程度的抽样为
A. 单纯随机抽样
B. 系统抽样
C. 分层抽样
D. 整群抽样
E. 多级抽样

正确答案：C。分层抽样

解析：本题考查分层抽样的分层因素。常用的分层因素有年龄、性别、文化程度的抽样为分层抽样（C对）。分层抽样先将是指先将总体按某种特征分成若干个“层”，即组别或类型等，再在每个层中用随机方式抽取调查对象，再将每个层所有抽取的调查对象合成一个样本，称分层抽样。常用的分层因素有年龄、性别、居住地、文化程度、经济条件等。还可分成等比例（即按比例）和不等比例（即最优分配）两种分层随机抽样。单纯随机抽样（A错）、系统抽样（B错）、整群抽样（D错）、多级抽样（E错）均不以年龄、性别、文化程度作为分层因素，不符合题意。